寄生虫卵作为评价土壤清洁程度的指标是
A. 鞭虫卵
B. 蛔虫卵
C. 血吸虫卵
D. 钩虫卵
E. 活寄生虫卵

正确答案：B。蛔虫卵

解析：本题考查评价土壤清洁程度的寄生虫卵指标。蛔虫卵数对判定土壤污染有重要意义，它可以直接说明在流行病学上是否对人体健康有威胁。根据蛔虫卵（B对ACDE错）在土壤中的不同发育阶段以及活卵所占的百分比来判断土壤的自净程度。例如，大部分蛔虫卵是死卵，表明土壤已达到自净，危险性较小。